婚后要求短期避孕者
A. 以外用避孕药为宜，采用避孕阴茎套或外用避孕栓，以后可使用女性外用避孕药具如阴道隔膜、避孕海绵、避孕药膜，阴道套等，也可采用自然避孕法，具有经济简便、安全、无害的优点，但单用此法易失败需谨慎
B. 除可选用各种外用避孕药具外，如无用药禁忌可口服女用避孕药，以短效者为宜
C. 探亲避孕药，避孕药需正确使用方可获高效。但必须注意，应在停药3~6个月才能受孕，以防影响胎儿
D. 应选用长效、安全、简便、经济的避孕方法。如宫内节育器，长效避孕针、药、阴道药环、皮下埋植等方法，也可根据具体情况选用。凡属终生不宜生育者，原则上有病一方应采取绝育或长效避孕措施
E. 及早行人工流产术

正确答案：A。以外用避孕药为宜，采用避孕阴茎套或外用避孕栓，以后可使用女性外用避孕药具如阴道隔膜、避孕海绵、避孕药膜，阴道套等，也可采用自然避孕法，具有经济简便、安全、无害的优点，但单用此法易失败需谨慎

解析：本题考查常用的避孕方法。婚后要求短期避孕者，避孕时以外用避孕药为宜，采用避孕阴茎套或外用避孕栓，以后可使用女性外用避孕药具如阴道隔膜、避孕海绵、避孕药膜，阴道套等，也可采用自然避孕法，具有经济简便、安全、无害的优点，但单用此法易失败需谨慎（A对BCDE错）。